脊髓的硬膜外隙
A. 内含疏松结缔组织、脂肪和肌肉组织
B. 此间隙略呈负压
C. 无脊神经通过
D. 临床上静脉麻醉的注药部位
E. 无

正确答案：B。此间隙略呈负压

解析：硬膜外隙是硬脊膜与椎管内面的骨膜之间的间隙，内含疏松结缔组织、脂肪、淋巴管、静脉丛和脊神经根等，不含肌肉组织（AC错）。此间隙略呈负压（B对），不与颅腔内相通。脊髓的硬膜外隙是临床上进行硬膜外麻醉的注药部位（D错），将药物注入此间隙，以阻滞脊神经根内的神经传导。